功用为泻火通便清上泄下的方剂是
A. 竹叶石膏汤
B. 黄连解毒汤
C. 凉膈散
D. 白虎汤
E. 大承气汤

正确答案：C。凉膈散

解析：功用为泻火通便清上泄下的方剂是凉膈散，主治上中二焦邪郁生热证，本方由脏腑积热聚于胸膈所致，为治疗上、中二焦火热炽盛的常用方（C对）。竹叶石膏汤功用清热生津，益气和胃（A错）。黄连解毒汤功用泻火解毒（B错）。白虎汤功用清热生津（D错）。大承气汤功用阳明腑实证，热结旁流证，里热实证之热厥、痉病或发狂（E错）。